肝脏的血液供应来自门静脉的约占
A. 30～35%
B. 40～45%
C. 50～55%
D. 60～65%
E. 70～75%

正确答案：E。70～75%

解析：肝脏由双重血液供应，来自门静脉的约占70%～75%（E对），来自肝动脉的约占25%～30%。